甘草具有的功效是
A. 固表止汗
B. 润肠通便
C. 补血养阴
D. 清热解毒
E. 补脾止泻

正确答案：D。清热解毒

解析：甘草具有补脾益气，祛痰止咳，缓急止痛，清热解毒，调和诸药的功效。甘草长于解毒，应用广泛。生品药性微寒，可清热解毒，对附子等多种药物和食物所致中毒，有一定解毒作用（ D对）。